属于长效β₂肾上腺素受体激动剂，可用于哮喘长期维持治疗的药物是
A. 噻托溴铵
B. 特布他林
C. 布地奈德
D. 孟鲁司特
E. 福莫特罗

正确答案：E。福莫特罗

解析：本题考查福莫特罗。属于长效β₂肾上腺素受体激动剂，可用于哮喘长期维持治疗的药物是福莫特罗（E对）。噻托溴铵（A错）为长效M胆碱受体阻断剂，用于慢性阻塞性肺疾病的维持治疗。特布他林（B错）为短效β₂受体激动剂，用于支气管哮喘、慢性支气管炎、肺气肿和其它伴有支气管痉挛的肺部疾病。布地奈德（C错）属于吸入性糖皮质激素，用于支气管哮喘的症状和体征的长期控制。孟鲁司特（D错）为白三烯受体阻断剂，用于15岁及15岁以上哮喘患者的预防和长期治疗，包括预防白天和夜间的哮喘症状，治疗对阿司匹林敏感的哮喘以及预防运动诱发的支气管哮喘。